以下哪条动脉是椎动脉的分支
A. 大脑前动脉
B. 小脑下后动脉
C. 迷路动脉
D. 大脑中动脉
E. 无

正确答案：B。小脑下后动脉

解析：椎动脉的主要分支有脊髓前、后动脉和小脑下后动脉（B对）。颈内动脉的分支有大脑前动脉（A错）、大脑中动脉（D错）、脉络丛前动脉、后交通动脉。脑迷路动脉（C错）是基底动脉的分支。